以丙烯酸树脂、羟丙甲纤维素包衣制成的片剂是
A. 糖衣片
B. 植入片
C. 薄膜衣片
D. 泡腾片
E. 口含片

正确答案：C。薄膜衣片

解析：本题考查片剂的包衣。以丙烯酸树脂、羟丙甲纤维素包衣制成的片剂为薄膜包衣（C对）。糖衣片（A错） 指衣层以蔗糖为主的药剂包衣片；植入片（B错）是指埋植到人体皮下缓缓溶解、吸收的片剂；泡腾片（D错）是指含泡腾崩解剂，遇水可产生气体而呈泡腾状的片剂；口含片（E错）是缓慢含化、通过舌下和口腔颊面黏膜吸收的片剂。